奥司他韦治疗流行性感冒，首次用药的时间是
A. 出现流感症状后48小时内
B. 出现流感症状后72小时内
C. 出现流感症状后96小时内
D. 出现流感症状后100小时内
E. 出现流感症状后120小时内

正确答案：A。出现流感症状后48小时内

解析：本题考查奥司他韦的使用。奥司他韦治疗流行性感冒，首次用药的时间是在流感症状开始的第1或第2天开始治疗（A对）。奥司他韦治疗流行性感冒，于出现流感症状48小时内给药效果最佳。